女，2.5岁。高烧3天，口腔溃疡病2天。啼哭，流涎，拒食。体检发现患儿全口牙龈红肿，上腭黏膜可见密集的针头大小透明水疱，部分已破溃为浅表溃疡，周围黏膜充血水肿广泛。本病例最可能的诊断为疱疹性龈口炎，根据本病的临床表现，首选的辅助检查为
A. 尿常规检查
B. 血常规及分类检查
C. 活检
D. T细胞亚群测定
E. 肝肾功能

正确答案：B。血常规及分类检查

解析：本题考查疱疹性龈口炎的辅助检查。疱疹性龈口炎会引起全身症状，如高烧、头痛、白细胞增高等，所以需要进行血常规及分类检查（B对），判断感染情况，以指导全身抗病毒治疗和对症及支持治疗。尿常规（A错）主要用于检查肾功能。活检（C错）主要用来确定检查组织的病理性质。T细胞亚群测定（D错）主要用于了解不同情况下体内免疫功能状态。肝肾功能（E错）主要了解肝肾功能状态。